为了切实做到尊重患者自主性或决定，医生向患者提供信息时要避免
A. 理解
B. 诱导
C. 适量
D. 适度
E. 开导

正确答案：B。诱导